患者，男，71岁，因“慢性咳嗽、咯痰20余年，活动后气短1年”就诊。曾确诊为COPD。近1年平地走200～300米即感到气短，近期无发热，痰液量和外观无明显变化，但常有心悸、手抖，并且口中有苦涩的金属味道。目前应用茶碱缓释片口服，沙丁胺醇气雾剂吸入，异丙托溴胺气雾剂吸入。患者有长期吸烟史，无其他慢性病。关于该患者COPD治疗及疾病管理的说法，错误的是
A. 吸烟是COPD最重要的发病因素，建议戒烟
B. 建议长期单独吸入沙丁胺醇，以降低病死率
C. 稳定期规律吸入长效支气管扩张剂，以减少急性加重的频率
D. 建议在专业人员指导下进行适度运动
E. 建议每年接种流感疫苗

正确答案：B。建议长期单独吸入沙丁胺醇，以降低病死率

解析：本题考查沙丁胺醇。沙丁胺醇为短效β₂受体激动剂，是缓解轻至中度哮喘急性症状的首选药物，也可用于预防运动性哮喘，长期使用可形成耐药性，药效降低，使支气管痉挛不易缓解，哮喘加重，故应按需使用，不宜长期、单一、过量应用（B错，为本题正确答案）。COPD的管理和预防：（1）建议在专业人员指导下进行适度运动（D对）。（2）减少危险因素暴露：吸烟是COPD最重要的发病因素，建议戒烟（A对）。（3）疫苗：建议每年接种流感疫苗（E对），流感疫苗的应用可减少COPD患者发生严重疾病和死亡风险。（4）肺康复：肺康复是改善呼吸困难、健康状况和运动耐力的最有效治疗策略。（5）氧疗。（6）无创通气。稳定期规律吸入长效支气管扩张剂，可减少急性加重的频率（C对）。